属于营养必须氨基酸的是
A. 甘氨酸
B. 酪氨酸
C. 丙氨酸
D. 甲硫氨酸
E. 谷氨酸

正确答案：D。甲硫氨酸

解析：营养必需氨基酸指体内需要而不能自身合成，必须由食物提供的氨基酸，包括亮氨酸、异亮氨酸、苏氨酸、缬氨酸、赖氨酸、甲硫氨酸（D对）、苯丙氨酸、色氨酸和组氨酸。甘氨酸（A错）、酪氨酸（B错）、丙氨酸（C错）、谷氨酸（E错）均可由自身合成，不是营养必需氨基酸。